女性，腹痛，反酸，胃镜检查提示:十二指肠球部溃疡，快速尿素酶实验阳性，下列哪项说法是正确的
A. 需联合药物治疗
B. 革兰染色阳性
C. 需要大量能量
D. 厌氧菌
E. 生化反应活跃

正确答案：A。需联合药物治疗

解析：患者女性，有腹痛，反酸的症状，胃镜提示十二指肠球部溃疡，快速尿素酶实验阳性提示有幽门螺杆菌感染，结合患者的表现和辅助检查，需要给予联合药物治疗（A对）。BCDE选项在内科学9版教材未明确说明。